二仙汤合二至丸可用于治疗绝经期综合征的哪个类型
A. 肾阴不足
B. 肾阳亏虚
C. 肝肾阴虚
D. 肝阳上亢
E. 肾阴阳两虚

正确答案：E。肾阴阳两虚

解析：绝经期综合征治疗以调补肾阴阳为主，二仙汤合二至丸滋阴补肾，调补冲任，适用于肾阴阳两虚证（E对）。绝经期综合征主要为绝经前后，天癸将绝，肾气渐虚，肾阴阳失调，易波及其他脏腑，而其他脏腑病变，久必伤肾，故本病之本在肾，常累及心、肝、肾等多脏、多经，致使本病证候复杂，所以常见证型为肝肾阴虚、肾虚肝郁、心肾不交、肾阴阳两虚四证。绝经期综合征因其病证候复杂，所以无单纯的肾阴不足（A错）、肾阳亏虚（B错）、肝阳上亢（D错）证。肝肾阴虚证（C错）方选杞菊地黄丸。